可用于降低眼压的药物是
A. 利福平
B. 卡替洛尔
C. 左氧氟沙星
D. 阿托品
E. 利巴韦林

正确答案：B。卡替洛尔

解析：本题考查眼科疾病药物的分类。卡替洛尔（B对）为β受体阻断剂类降低眼压的药物，用于青光眼，高眼压症。利福平（A错）、左氧氟沙星（C错）为抗眼部细菌感染药。阿托品（D错）为抗M胆碱类散瞳剂。利巴韦林（E错）为抗眼部病毒感染药，用于单纯疱疹病毒性角膜炎。